成釉器的帽状期与钟状期相比，缺少哪层细胞
A. 外釉上皮
B. 内釉上皮
C. 星网状层
D. 中间层
E. 成牙本质细胞层

正确答案：D。中间层

解析：本题考查牙胚的发生及分化。成釉器帽状期分化为三层细胞：外釉上皮层、内釉上皮层和星网状层。而在钟状期则分化为四层细胞：外釉上皮层、内釉上皮层、中间层（D对）和星网状层。